中国药典规定，应检查有机氯农药残留量的药材是
A. 细辛
B. 甘草
C. 泽泻
D. 附子
E. 狗脊

正确答案：B。甘草

解析：本题考查的是中药的毒性成分。中国药典规定，应检查有机氯农药残留量的药材是甘草（B对）。农药残留量：农药的种类很多，主要有机氯、有机磷和拟除虫菊酯类等。其中有机氯类农药中滴滴涕（DDT）和六六六（BHC）是使用最久、数量最多的农药。虽然大多数国家已于20世纪七八十年代开始禁用有机氯农药，停止生产滴滴涕和六六六，但由于它们在土壤或生物体中长期残留和蓄积会危害人体健康，故各国依然都非常重视食品和药物中残留量的检测和限量问题。《中国药典》规定，人参和西洋参中含五氯硝基苯不得过0.1mg/kg，六氯苯不得过0.1mg/kg，七氯（七氯、环氧七氯之和）不得过0.05mg/kg ，氯丹（顺式氯丹、反式氯丹、氧化氯丹之和）不得过0.1mg/kg；甘草和黄芪中含五氯硝基苯不得过0.1mg/kg。有机磷农药常见的有敌敌畏、对硫磷、乐果等。《中国药典》采用气相色谱法测定药材及制剂中部分有机氯、有机磷和拟除虫菊酯类的农药残留量。细辛（A错）含有痕量的马兜铃酸Ⅰ，有肝肾毒性。《中国药典》对马兜铃酸Ⅰ进行限量检查，要求其含量不得过0.001%。附子（D错）含双酯型生物碱，具麻辣味，毒性极强。《中国药典》要启用采用高效液相色谱法测定其双酯型生物碱。